儿童感染戊肝病毒后，常表现为
A. 显性感染
B. 潜伏性感染
C. 隐性感染
D. 病毒携带者
E. 病毒清除

正确答案：C。隐性感染

解析：儿童感染戊肝病毒后，常表现为隐性感染（C对），人群对戊肝病毒普遍易感，青壮年发病率高，儿童和老人发病率较低，一般隐性感染随年龄增长而下降，显性感染随年龄增长而上升，成人以显性感染（A错）多见。潜伏性感染（B错）、病毒携带者（D错）、病毒清除（E错）均不是感染戊肝的常见表现。